小儿生理特点中，“稚阳”的“阳”，是指
A. 脏腑的生理功能
B. 肢体的功能活动
C. 精、血、津、液等物质
D. 生长发育的生机
E. 脏气清灵的特征

正确答案：A。脏腑的生理功能

解析：吴鞠通的稚阴稚阳理论，从阴阳学说方面进一步阐明了小儿时期的机体，无论是在形体方面还是在生理功能方面，都处于相对不足的状态，其中“阳”指脏腑的生理功能（A对）。肢体的功能活动由脏腑所主，不足以概括其生理整体（B错）。精、血、津、液等物质属有形之质属“阴”（C错）。生长发育的生机指小儿生理特点的“纯阳”（D错）。脏气清灵的特征，指与成人相比，小儿的机体生机蓬勃，脏腑之气清灵，随拨随应，对各种治疗反应灵敏，并且小儿宿疾较少，病情相对单纯（E错）。